慢性肾功能不全周围神经病变中较明显症状的表现
A. 弛缓性瘫痪
B. 震颤
C. 不宁腿综合征
D. 肌无力
E. 偏身瘫痪

正确答案：C。不宁腿综合征

解析：慢性肾功能不全患者周围神经病变很常见，以感觉神经障碍为著，最常见的是肢端袜套样分布的感觉丧失，也可有肢体麻木、烧灼感或疼痛感、深反射迟钝或消失，并可有神经肌肉兴奋性增加（如肌肉震颤、痉挛、不宁腿综合征），以及肌萎缩、肌无力等。在周围神经病变引起的震颤（B错）、不宁腿综合征、肌无力（D错）中，较明显的症状是不宁腿综合征（C对）。不宁腿综合征（七版神经病学P420）患者一般有强烈活动双腿的愿望，常伴肢体远端不适感，活动、捶打后可缓解。弛缓性瘫痪（七版神经病学P55）（A错）也称下运动神经元性瘫痪、周围性瘫痪，是由于下运动神经元，即脊髓前角细胞或脑干脑神经运动核及其发出的神经纤维病变所致。偏身瘫痪（七版神经病学P55）（E错）主要见于上运动神经元受损。